男性，7岁。诉下颌前牙松动。口腔检查见：右下乳切牙松动Ⅲ°，牙冠有深龋洞，右下1已从舌侧萌出，诊断
A. 乳牙滞留
B. 乳牙早失
C. 乳牙根尖周炎
D. 乳牙牙周炎
E. 乳牙外伤

正确答案：A。乳牙滞留

解析：本题考查乳牙滞留的临床表现。乳牙滞留（A对）是指继承恒牙已萌出，未按时脱落的乳牙，或恒牙未萌出，保留在恒牙列中的乳牙。乳牙滞留诊断的依据是，已到达替换时期尚未替换的乳牙，而且该乳牙牙根部或唇、颊、舌侧又有继承恒牙萌出。乳牙早失易引起继发恒牙近远中倾斜（B错）；乳牙根尖周炎可导致恒牙釉质发育不全（C错）；乳牙牙周炎一般不会导致继发恒牙的异位萌出（D错）；乳牙外伤可表现为嵌入、脱出、唇舌向移位（E错），该患者为乳切牙未脱落，而恒切牙已萌出，因此可诊断为乳牙滞留。